氟康唑质量标准中，光谱鉴别采用的方法是
A. 非水溶液滴定法
B. 旋光度测定法
C. 气相色谱法
D. 氧瓶燃烧-比色法
E. 红外分光光度法

正确答案：E。红外分光光度法

解析：本题考查氟康唑的鉴别方法。氟康唑的光谱鉴别采用红外分光光度法（E对）。取含量测定项下的供试品溶液，照分光光度法（中国药典1995年版二部附录ⅣA）测定，在261nm和267nm的波长处有最大的吸收，在264nm的波长处有最小吸收。